肾结石1.9cm，首选治疗方案是
A. 体外冲击波碎石
B. 经皮肾碎石
C. 经输尿管碎石
D. 腹腔镜下取石或开放性手术取石
E. 药物治疗及大量饮水

正确答案：A。体外冲击波碎石

解析：体外冲击波碎石（ESWL）（A对）是通过X线或超声波对结石进行定位，利用高能冲击波聚焦后作用于结石，使结石裂解、粉碎后随尿液排出体外，其适用于直径≤2cm的肾结石和输尿管上段结石的治疗。经皮肾碎石（B错）适用于所有需手术干预的肾结石，包括完全性和不完全性鹿角结石、≥2cm的肾结石、有症状的肾盏或憩室内结石、体外冲击波难以粉碎及治疗失败的结石，以及部分L4以上较大的输尿管上段结石。输尿管镜取石（C错）适用于中下段输尿管结石和泌尿系平片不显影的结石。开放手术治疗（D错）因手术给病人造成较大的创伤，复杂性结石一次难以取尽，复发率高，重复取石危险性大，较少采用。腹腔镜取石（D错）适用于输尿管结石＞2cm，原考虑开放手术，或经体外冲击波碎石、输尿管镜手术治疗失败者。药物治疗（E错）适用于结石直径＜0.6cm、表面光滑、结石以下尿路无梗阻，药物治疗过程中，大量饮水目的在于增加尿量，稀释尿中结石物质的浓度，减少晶体沉积，促进结石排出。